子痫前期常导致的并发症是
A. 前置血管
B. 葡萄胎
C. 子宫破裂
D. 胎盘早剥
E. 前置胎盘

正确答案：D。胎盘早剥

解析：子痫前期是妊娠期高血压疾病中的一种，至今病因不明，可能跟子宫螺旋小动脉重铸不足有关。妊娠期高血压患者的滋养层细胞浸润过浅，只有蜕膜层血管重铸，俗称“胎盘浅着床”，导致胎盘血流灌注下降，加之伴有内皮损害及胎盘血管急性动脉粥样硬化，可导致胎盘床血管破裂，发生胎盘早剥（D对）。前置血管（A错）（P141）是指胎膜上的血管跨过宫颈内口位于胎先露部前方的现象，当胎膜破裂时，伴前置血管破裂出血达200～300ml时可导致胎儿死亡；若前置血管受胎先露部压迫，可导致脐血循环受阻，胎儿窘迫或死亡。葡萄胎（B错）（P334）因妊娠后胎盘绒毛滋养细胞增生、间质水肿，而形成大小不一的水泡，水泡间借蒂相连成串，形如葡萄而名之，也称水泡状胎块，属于胎盘滋养细胞疾病，病因尚不完全清楚。子宫破裂（C错）（P218）是指妊娠晚期或分娩期子宫体部或子宫下段发生裂开，为产科严重并发症，因瘢痕子宫、梗阻性难产、子宫收缩药物使用不当、产科手术损伤等导致。前置胎盘（E错）（P126）指妊娠28周后，胎盘附着于子宫下段、下缘达到或覆盖宫颈内口，位置低于胎先露部，是妊娠晚期严重并发症之一，也是妊娠晚期阴道流血最常见的原因；可能与以下因素有关：1）子宫内膜病变或损伤：多次流产及刮宫、产褥感染、子宫手术史、盆腔炎等；2）胎盘异常：大小和形态异常，胎盘面积过大、膜状胎盘大面薄等；3）受精卵滋养层发育迟缓。